某地区开展了20年用PSA蛋白筛查前列腺癌的项目。分析发现，该地区前列腺早诊率高于未开展筛查地区，有研究者据此认为，PSA筛查前列腺癌具有可推广价值。你对该结论的看法是
A. 结论合理，筛查有效地发现了隐匿的患者，效果明显
B. 结论不合理，不符合卫生经济学低成本高效益原则
C. 尚不能下结论，可能存在志愿者偏倚
D. 尚不能下结论，应比较开展和未开展地区的前列腺癌死亡率差异
E. 尚不能下结论，PSA筛查方法的准确性有待评价

正确答案：D。尚不能下结论，应比较开展和未开展地区的前列腺癌死亡率差异

解析：本题考查该筛检生物学效果评价。如果经筛检的病例较未经筛查的复发率或病死率更低，生存率较高或者生存时间更长，则说明筛查可能有效。本题中某地区前列腺癌筛查项目早诊率高于未开展筛查地区，尚不能下结论PSA筛查前列腺癌具有可推广价值，应比较开展和未开展地区的前列腺癌死亡率差异（D对ABCE错）。